不属于息止颌位的前提条件的是
A. 不咀嚼
B. 不吞咽
C. 不说话
D. 下颌处于休息状态
E. 上下颌牙弓处于闭合状态

正确答案：E。上下颌牙弓处于闭合状态

解析：当头直立位，口腔在不咀嚼、不吞咽、不说话的时候，下颌处于休息状态，上下颌牙弓自然分开，从后向前保持着一个楔形间隙，称为息止（牙合）间隙，也称为自由间隙，约为1～3mm。掌握“下颌姿势位、三类颌位与前伸、侧方（牙合）颌位”知识点。